乳房脓肿切开引流处理错误的是
A. 可以做对口引流
B. 应做放射状切开
C. 切开乳管充分引流
D. 乳晕下脓肿应沿乳晕边缘作弧形切口
E. 深部脓肿可沿乳房下缘做弧形切口

正确答案：C。切开乳管充分引流

解析：乳腺由15～20个腺叶组成，腺叶和乳管均以乳头为中心呈放射状排列。乳房表浅脓肿切开引流，应以乳头为中心作放射状切开（B对）。手术切口应尽量避免损伤乳管，以减少术后乳瘘的发生率，而不是切开乳管充分引流（C错，为本题正确答案）。乳晕下脓肿沿乳晕边缘做弧形切口（D对）。深部脓肿可沿乳房下缘做弧形切口（E对），经乳房后间隙引流。脓肿较大时，可以做对口引流（A对）。